充填术后，下列哪一条原因一般不会出现冷热痛
A. 无基底或基底不良
B. 充填物未恢复与邻牙接触点
C. 充填物脱落
D. 充填物与洞壁不密合或折裂

正确答案：B。充填物未恢复与邻牙接触点

解析：本题考查充填后疼痛。充填物未恢复与邻牙接触点，可导致食物嵌塞，引起牙龈炎症，出现持续性自发性痛，可定位，与温度刺激无关，咀嚼可加重疼痛（B错，为本题的正确答案）。无基底，冷热刺激可通过充填材料传至牙髓，引起冷热痛；基底不良，刺激性的垫底材料可造成对牙髓的化学刺激而激惹牙髓，致牙髓充血，出现冷热刺激痛（A对）。充填体脱落，窝洞内的牙本质直接暴露于口腔中，冷热刺激进入窝洞可引起激发痛（C对）。充填物与洞壁不密合或折裂，会出现微渗漏，冷热刺激从裂隙处进入窝洞深部出现冷热痛（D对）。